下列哪项不是经期延长阴虚血热证的主症
A. 月经持续8、9日，量少、色红、质稠
B. 腹疼痛拒按
C. 咽干口燥
D. 手足心热
E. 舌红少苔，脉细数

正确答案：B。腹疼痛拒按

解析：经期延长阴虚血热证阴虚内热，热扰冲任，冲任不固，经血失约，故行经时间延长；阴虚水亏，故经量少，火旺故经色鲜红，质稍稠（A对）；虚火灼津，津液不能上承则咽干口燥（C对）；手足心热（D对），两颧潮红，大便燥结，舌红，少苔，脉细数（E对）均为阴虚内热之征（B错，为本题正确答案）。